全口义齿初戴时，如果出现前牙开（牙合），其可能原因有，除了
A. 口内取颌位关系时错误
B. 转移颌位关系过程错误
C. 上下颌基托远中部有早接触
D. 后牙区咬合高
E. 患者不会使用义齿

正确答案：E。患者不会使用义齿

解析：本题考查出现前牙开（牙合）的原因。患者不会使用义齿（E错，为本题的正确答案）是初戴不适应，经过医生的指导和患者的一段时间的适应便会逐渐恢复，不会引起前牙开（牙合）。口内取颌位关系时错误（A对）或转移颌位关系过程错误（B对）都会导致制作的最终义齿出现前牙开（牙合）等颌位关系错误。上下颌基托远中部有早接触（C对）或后牙区咬合高（D对），则前牙不接触，表现为前牙开（牙合）。